患者，女，26岁，已婚。产后月余，遍身关节疼痛，四肢酸楚麻木，头晕心悸，舌淡红苔白，脉细无力。其证候是
A. 肝阴虚
B. 气虚
C. 肾虚
D. 风寒
E. 血虚

正确答案：E。血虚

解析：患者已婚，产后百骸空虚，血虚经脉失养，遍身关节酸楚、疼痛；头晕心悸，舌淡红苔白，脉细无力是血虚之象（E对）。肝阴虚证以头晕、目眩、胁痛、烦热等为主要表现的虚热证候(A错)。气虚以气短、乏力、神疲。脉虚等为主要表现的虚弱证候（B错）。肾虚证又分肾阳虚证，常见腰膝酸冷，性欲减退，夜尿多；肾气虚证常见腰膝酸软，小便、精液、经带、胎气不固；肾阴虚常见腰酸而痛，遗精、经少、头晕耳鸣之象（C错）。风寒常见恶寒重，发热轻，无汗，脉浮紧，苔白之象（D错）。